艾绒的制品有
A. 艾炷
B. 纯艾条
C. 太乙针灸条
D. 雷火针灸条
E. 常用药艾条

正确答案：A、B、C、D、E。艾炷；纯艾条；太乙针灸条；雷火针灸条；常用药艾条

解析：本题考查的是艾绒的制品。艾绒的制品有艾炷（A对）、纯艾条（B对）、太乙针灸条（C对）、雷火针灸条（D对）、常用药艾条（E对）。艾绒的制品有艾炷、纯艾条、太乙针灸条、雷火针灸条、常用药艾条。